下列各项，不属于人禽流感并发症的是
A. 胸腔积液
B. ARDS
C. 肺炎
D. 脑炎
E. 休克

正确答案：D。脑炎

解析：人禽流感重症患者病情发展迅速，可出现肺炎、急性呼吸窘迫综合征（ARDS）、肺出血、胸腔积液、全血细胞减少、肾衰竭、败血症、休克及Reye综合征等多种并发症（D对）。